恶性多形性腺瘤多见于
A. 下颌下腺
B. 腮腺
C. 腭腺
D. 上唇
E. 下唇

正确答案：B。腮腺

解析：恶性多形性腺瘤又称为多形性腺瘤癌变，多见于腮腺，其次为下颌下腺、腭及上唇，男性多于女性。掌握“基底细胞腺瘤及恶性多形性腺瘤”知识点。